男，21岁。头部摔伤2小时，头颅CT示后颅窝高密度影，发生脑疝。其类型最可能是
A. 小脑幕切迹疝
B. 大脑镰下疝
C. 穿颅疝
D. 小脑幕切迹上疝
E. 枕骨大孔疝

正确答案：E。枕骨大孔疝

解析：该患者外伤后头颅CT示后颅窝高密度影，提示颅后窝内血肿，因此最可能发生的脑疝类型是枕骨大孔疝（E对）。颅后窝的血肿导致颅后窝局部颅压增高，脑脊液经枕骨大孔流入椎管，颅内蛛网膜下腔包括小脑延髓池的体积逐渐缩小，两侧扁桃体及相邻的小脑组织可经枕骨大孔向下移入椎管，形成枕骨大孔疝。小脑幕切迹疝（A错）常见于一侧颞叶或大脑半球外侧面病变；大脑镰下疝（B错）多见于一侧大脑半球额顶区占位病变；小脑幕切迹上疝（D错）较少见，多由于颅后窝占位性病变导致颅后窝压力高于幕上所致。